患者，女，83岁，左心室肥大、慢性心力衰竭病史5年，NYHA心功能Ⅲ级，肝肾功能正常，近日诊断为2型糖尿病，应避免使用的降糖药物是
A. 西格列汀
B. 格列齐特
C. 瑞格列奈
D. 利拉鲁肽
E. 吡格列酮

正确答案：E。吡格列酮

解析：本题考查降糖药。应避免使用的降糖药物是吡格列酮（E错，为本题正确答案），因为吡格列酮的不良反应有肝功能异常、头痛、肌痛、上呼吸道感染、水肿。西格列汀（A对）的不良反应有过敏反应、血管性水肿、皮疹、荨麻疹、皮肤血管炎以及剥脱性皮肤损害。格列齐特（B对）的不良反应有头痛，极度饥饿，恶心，呕吐，倦怠，倦睡，睡眠障碍，激动，攻击性行为等。瑞格列奈（C对）的不良反应有胃肠道反应、过敏反应、低血糖等。利拉鲁肽（D对）的不良反应有恶心、呕吐等。